对舒必利描述正确的有
A. 结构中有氟苯基团
B. 结构中有苯甲酰胺片断
C. 结构中有一个手性碳原子
D. 结构中有吩噻嗪环
E. 结构中有2个手性碳原子

正确答案：B、C。结构中有苯甲酰胺片断；结构中有一个手性碳原子